关于牙本质龋中的脱矿层的描述中，正确的是
A. 脱矿后色素不易沉着
B. 成牙本质细胞突起在细菌酶的作用下可发生脂肪变性
C. 扩张的小管可排列成串珠状
D. 牙本质小管形态较完整
E. 是牙本质龋最深层的改变

正确答案：D。牙本质小管形态较完整

解析：本题考查牙本质龋。关于牙本质龋中的脱矿层的描述中，正确的是牙本质小管形态较完整（D对）。脱矿层位于透明层的表面，是在细菌进入前，酸的扩散所导致的脱矿改变，此层牙本质小管形态仍然比较完整，牙本质脱矿后，由于细菌产物与牙本质中蛋白质相互作用的结果，色素容易沉着（A错），脱矿层可被染成棕黄色。成牙本质细胞突起在细菌酶的作用下可发生脂肪变性（B错）是透明层的表现，不是脱矿层的表现。透明层为牙本质龋最深层、最早出现的改变（E错）。细菌侵入层位于脱矿层表面，细菌侵入小管并繁殖，有的小管被细菌所充满，小管扩张呈串珠状（C错）。